女，43岁。乙肝肝硬化10年，近1周来高热伴乏力，出现鼻出血和皮肤多处瘀斑。为确定患者是否并发DIC，最有价值的实验室检查指标是
A. 血浆FⅧ：C下降
B. APTT延长
C. 血浆凝血酶原下降
D. 血浆纤维蛋白原下降
E. PT延长

正确答案：A。血浆FⅧ：C下降

解析：凝血因子FⅧ是由肝间质组织的单核巨噬细胞系统合成的，严重肝病时，尽管大多数凝血因子合成减少，活性降低，但由于肝库普弗细胞功能亢进，血浆FⅧ：C活性增强，而DIC时凝血因子消耗过多，导致包括FⅧ在内的所有凝血因子活性均降低，故血浆FⅧ：C活性（A对）是二者鉴别最有价值的实验室检查项目。APTT（活化的部分凝血活酶时间）延长（B错）反映内源性凝血途径异常；血浆凝血酶原下降（C错）、PT（凝血酶原时间）延长（E错）反映外源性凝血途径异常；血浆纤维蛋白原下降（D错）反映共同凝血途径异常，DIC、严重肝病时均有大量凝血因子减少，故BCDE都不是二者鉴别的实验室指标。